郁证的病位多在
A. 心、脾、胃
B. 肝、脾、胃
C. 肝、脾、肾
D. 肝、胃、肾
E. 心、肝、脾

正确答案：E。心、肝、脾

解析：郁证的基本病机是肝失疏泄、脾失健运、心失所养、脏腑阴阳气血失调。郁证的发病与肝的关系最为密切，其次涉及心、脾，所以郁证的主要病位在心、肝、脾（E对）。郁证的发生，主要是因郁怒、思虑、悲哀、忧愁等七情所伤，以致肝失疏泄，脾失健运，心神失常，脏腑阴阳气血失调所引发，胃不是其病位（A错）。郁证的病位可以概括为心、肝、脾，胃不是其病位（B错）。郁证的发病与肝的关系最为密切，其次涉及心、脾。与肾不是很密切（C错）。郁证的病位可以概括为心、肝、脾，胃不是其病位（D错）。